下列选项中符合手术治疗伦理要求的是
A. 手术方案应当经患方知情同意
B. 患者坚决要求而无指征的手术也可实施
C. 手术对患者确实有益时，可无需患者知情同意
D. 手术方案必须经患者单位同意
E. 患者充分信任时，医生可自行决定手术方案

正确答案：A。手术方案应当经患方知情同意

解析：在接受手术治疗之前，病人有权知道自己的病情及可选的治疗方案，并对医生提出的治疗方案有最后选择的决定权。在任何情况下，医师均应尊重病人的知情同意权，即使手术对患者有益，手术方案应当经患方知情同意（A对CDE错）。医务人员选择某一治疗方案时，必须严格掌握疾病情况和手术指征；充分考虑患者对这一创伤的接受程度；考虑病人付出各种代价后所得到的治疗效果是否满意；考虑这样的选择是否符合无伤害原则，并不是患者坚决要求而无指征的手术也可实施（B错）。